下列哪项不是腹股沟斜疝的特点
A. 多见于儿童及青壮年
B. 经腹股沟管突出，可进阴囊
C. 疝块呈椭圆或梨形，上部呈蒂柄形
D. 疝囊颈在腹壁下动脉内侧
E. 较多发生嵌顿

正确答案：D。疝囊颈在腹壁下动脉内侧

解析：腹股沟斜疝一般多见于儿童及青壮年（A对），疝块呈椭圆或梨形，上部呈蒂柄形（C对），经腹股沟管突出，可进阴囊（B错），较多发生嵌顿（E错），疝囊颈在腹壁下动脉外侧（D错，为本题正确答案）。